亚硝酸异戊酯是（）中毒的特效解毒剂
A. 硫化氢
B. 氰化氢
C. 一氧化碳
D. 苯胺

正确答案：B。氰化氢

解析：本题考查氰化氢中毒的药物选择。当氰化氢（B对ACD错）中毒时，有两种主要的解毒方法。①亚硝酸钠-硫代硫酸钠疗法：立即将亚硝酸异戊酯1～2支包在手帕或纱布内打碎，给病人吸入15～30秒，每隔3分钟重复应用1支（一般最多用6支），直至使用亚硝酸钠为止；②4-二甲基氨基苯酚（4-DMAP）的应用：为新型高铁血红蛋白生成剂，形成高铁血红蛋白的速度比亚硝酸钠快，不引起血压下降，且给药方便。